易变色的饮片是
A. 芫花
B. 辛夷
C. 密蒙花
D. 旋覆花
E. 金银花

正确答案：E。金银花

解析：本题考查的是中药饮片贮存中常见的质量变异现象。易变色的饮片是金银花（E对）。变色，是指饮片的色泽起了变化，如由浅变深或由鲜变暗等。各种饮片都有其固有的色泽，这也是中药饮片检查中的主要质量标志之一。饮片变色，是由于所含色素受到外界影响（如温度和湿度、日光、霉变、化学药剂的使用、硫黄熏蒸等）使饮片失去了其原有的色泽，影响饮片质量。比如硫黄熏后，产生的二氧化硫遇水成亚硫酸，具有还原作用，可使饮片褪色；再如由于保管不善，某些饮片的颜色由浅变深，如泽泻、白芷、山药、天花粉等；有些饮片由深变浅，如黄芪、黄柏等；有些饮片由鲜艳变暗淡，如红花、菊花、金银花、梅花等花类药。因此，色泽的变化可以直接反映其内在质量。芫花（A错）为易生虫饮片。易生虫饮片：党参、人参、南沙参、冬虫夏草、当归、独活、白芷、防风、板蓝根、甘遂、生地、泽泻、全瓜蒌、枸杞子、大皂角、桑葚、龙眼肉、核桃仁、莲子、薏苡仁、杏仁、青风藤、桑白皮、鹿茸、蕲蛇、鸡内金、菊花、金银花、凌霄花、北沙参、防己、莪术、川贝母、金果榄、佛手、陈皮、砂仁、酸枣仁、红花、闹羊花、蒲黄、芫花、蝉蜕、黄柏、狗肾、地龙、甘草、黄芪、山药、天花粉、桔梗、灵芝、猪苓、茯苓、水蛭、僵蚕、蜈蚣、乌药、葛根、丹参、何首乌、赤芍、苦参、延胡索、升麻、萆薢、大黄、肉豆蔻、淡豆豉、柴胡、地榆、川芎、半夏、玉竹。辛夷（B错）、密蒙花（C错）与旋覆花（D错）的质量变异现象，2022年考试指南未明确说明。